妇女最不应从事的劳动是
A. 驾驶作业
B. 负重作业
C. 流水线作业
D. 缝纫作业
E. VDT作业

正确答案：B。负重作业